糖衣片的崩解时限是
A. 1分钟
B. 5分钟
C. 15分钟
D. 30分钟
E. 60分钟

正确答案：E。60分钟

解析：本题考查片剂的崩解时限。糖衣片应在1小时内（E对）全部崩解。舌下片应在5分钟内（B错）全部崩解并溶化。薄膜衣片应在30分钟内（D错）全部崩解。